主要不良反应为胃肠反应的药物是
A. 阿卡波糖
B. 二甲双胍
C. 格列本脲
D. 胰岛素
E. 氯磺丙脲

正确答案：A。阿卡波糖

解析：本题考查降糖药的不良反应。阿卡波糖（A对）为α-葡萄糖苷酶抑制剂，可与碳水化合物竞争α-葡萄糖苷酶，抑制碳水化合物水解而滞留在胃肠道，引起肠道细菌酵解，产生气体，引起胀气、腹泻等胃肠道不良反应。服用二甲双胍（B错），少数患者可出现酮尿或乳酸性血症。格列本脲（C错）长期使用可抑制胰高血糖素的释放。胰岛素（D错）常见不良反应为低血糖反应，也可引起过敏性反应。氯磺丙脲（E错）不良反应为肝毒性。